按计划免疫接种程序，脊髓灰质炎疫苗的复种时间为
A. 6个月
B. 1岁
C. 2岁
D. 3岁
E. 4岁

正确答案：E。4岁

解析：基础免疫自出生后2月龄婴儿开始，接种1剂灭活脊灰疫苗(IPV），3月龄、4月龄和4周岁（E对）时分别接种1剂脊髓灰质炎减毒活疫苗。